某医生被吊销医师执业证书后，若其要重新注册需要
A. 自处罚执行完毕之日起至申请注册之日止满二年
B. 自处罚决定之日起至申请注册之日止满二年
C. 自处罚执行完毕之日起至申请注册之日止满三年
D. 自处罚决定之日起至申请注册之日止满三年
E. 以上都不对

正确答案：B。自处罚决定之日起至申请注册之日止满二年